某建筑工人因电击导致急性呼吸衰竭，送至医院急诊处理，关于区分急、慢性呼吸衰竭的关键在于
A. 有无发绀
B. 有无缺氧及二氧化碳潴留
C. 起病缓急
D. 有无肺气肿
E. 有无呼吸困难

正确答案：C。起病缓急

解析：呼吸衰竭按照发病缓急分为急性呼吸衰竭和慢性呼吸衰竭两大类。掌握“呼吸衰竭”知识点。